肉毒梭菌毒素食物中毒的主要症状为
A. 对称性脑神经受损
B. 上腹部阵发性绞痛
C. 败血症、脑膜炎
D. 剧烈的腹痛和呕吐
E. 运动神经麻痹

正确答案：E。运动神经麻痹